没有结肠带的肠管是
A. 盲肠
B. 横结肠
C. 升结肠
D. 乙状结肠
E. 直肠

正确答案：E。直肠

解析：结肠带为结肠和盲肠的特征性结构(ABCD对)，直肠没有结肠带(E错，为本题的正确答案)。